分子有氨基酮结构的，用于吗啡，海洛因等成瘾造成的戒断症状的治疗是
A. 盐酸美沙酮
B. 盐酸吗啡
C. 芬太尼
D. 盐酸哌替啶
E. 盐酸纳洛酮

正确答案：A。盐酸美沙酮

解析：本题考查美沙酮。美沙酮（A对）含有氨基酮结构，具有镇痛作用，且不易产生耐受性、药物依赖性低，常用作海洛因等成瘾造成的戒断症状治疗；盐酸吗啡（B错）为阿片受体激动剂，长期使用可产生严重的身体和精神依赖性；芬太尼（C错）为阿片受体激动剂，为强效麻醉性镇痛药；盐酸哌替啶（D错）为苯基哌啶衍生物，镇静、麻醉作用较小；盐酸纳洛酮（E错）其化学结构与吗啡相似，为阿片类的解毒剂。